《药品生产质量管理规范附录》规定，供角膜创伤或手术用滴眼剂的配制和灌装的洁净区洁净级别应为
A. 100级
B. 1000级
C. 10000级
D. 100000级
E. 300000级

正确答案：C。10000级